男，69岁。咳嗽、咳痰5个月，呈刺激性咳嗽，时有痰中带血，不伴发热、盗汗，吸烟史30余年，胸部X线示右肺门处团块状影。经抗感染治疗阴影不吸收。首选的治疗方案是
A. 继续抗感染治疗
B. 抗炎止血治疗
C. 手术治疗
D. 抗结核治疗
E. 免疫治疗

正确答案：C。手术治疗

解析：患者有30年吸烟史（肺癌危险因素），刺激性咳嗽5个月（刺激性咳嗽，非炎性疾病），不伴发热、盗汗，抗感染治疗无效（排除感染），胸部X线片见右肺门团块影，结合病史和临床表现以及X线检查可诊断为肺癌。故可排除继续抗感染治疗（A错）、抗炎止血治疗（B错）和抗结核治疗（D错），因免疫治疗（E错）价格昂贵，不属于首选，故正确答案为手术治疗（C对）。